固定桥受力时桥体弯曲程度与
A. 桥体厚度的立方成反比
B. 桥体长度的立方成正比
C. 桥体宽度成反比
D. 桥体的硬度有关
E. 以上均是

正确答案：E。以上均是

解析：本题考查固定桥受力时桥体弯曲变形的有关因素。在相同条件下，桥体的弯曲变形量与桥体厚度的立方成反比（A对）；与桥体长度的立方成正比（B对）；与桥体宽度成反比（C对）。另外，还与桥体材料的机械强度即桥体的硬度有关（D对），强度越大，越不易弯曲（ABCD均对，故E为本题的正确答案）。桥体的结构形态以及（牙合）力的大小也会影响桥体弯曲变形程度。